对病毒性肝炎的临床分性最有意义的依据是
A. 病程长短
B. 病情轻重
C. 血清转氨酶的检查
D. 病原学检查
E. 肝穿刺活检

正确答案：E。肝穿刺活检

解析：病毒性肝炎是由多种肝炎病毒引起的以肝脏病变为主的一种传染病。临床上以食欲减退、恶心、上腹部不适、肝区痛、乏力为主要表现。部分病人可有黄疸发热和肝大伴有肝功能损害。有些病人可慢性化，甚至发展成肝硬化，少数可发展为肝癌。对病毒性肝炎的临床分性最有意义的依据是肝穿刺活检（E对）。病程长短（A错）、病情轻重（B错）为临床表现，不能反映病毒性肝炎的临床分型。血清转氨酶的检查（C错）和病原学检查（D错）都是一般性的检查手段，并不是诊断病毒性肝炎最有意义的依据。